每分钟吸入肺泡的新鲜空气量是
A. 余气量
B. 肺活量
C. 功能余气量
D. 用力肺活量
E. 肺泡通气量

正确答案：E。肺泡通气量